宜选用利多卡因治疗的疾病是
A. 心房扑动
B. 房室早搏
C. 心房颤动
D. 急性心肌梗死引起的室性心律失常
E. 阵发性室上性心动过速

正确答案：D。急性心肌梗死引起的室性心律失常

解析：本题考查利多卡因。利多卡因对短动作电位时程的心房肌无效（ABC错），仅适用于室性心律失常（E错）。在急性心肌梗死患者中吸收较高，可用于急性心肌梗死引起的室性心律失常（D对）。